激活NK细胞的是
A. IL–1
B. IL–2
C. IL–4
D. IL–5
E. IL–6

正确答案：B。IL–2

解析：IL-2刺激T细胞增生，激活NK细胞。掌握“细胞因子及受体”知识点。